根据《药品管理法》的规定，“新药”系指
A. 我国药典未收载过的药品
B. 我国未上市过的药品
C. 我国未生产过的药品
D. 我国未使用过的药品
E. 我国未研究过的药品

正确答案：B。我国未上市过的药品

解析：本题考查新药。“新药”是指我国未上市过的药品（B对）。《中华人民共和国药品管理法实施条例》第十章附则第八十三条对新药的含义作了法定定义：新药，是指未曾在中国境内上市销售的药品。